正常菌群不正确的叙述是
A. 正常人体的体表及与外界相通的腔道中，都存在着不同种类和数量的微生物
B. 在正常情况下，这些微生物对人类无害
C. 机体有损伤和抵抗力降低时，原来为正常菌群的细菌也可引起疾病
D. 不会致病
E. 引起疾病的正常菌群称为条件致病菌或机会致病菌

正确答案：D。不会致病